以下吞咽过程的叙述中，正确的说法是
A. 吞咽的口腔阶段是食团由口腔至咽
B. 吞咽的咽腔阶段是食团由咽至食管上段
C. 吞咽的食管阶段是食团由食管下行至胃
D. 吞咽活动为一连续过程
E. 以上说法均正确

正确答案：E。以上说法均正确

解析：口腔阶段（食团由口腔至咽）；咽腔阶段（食团由咽至食管上段）；食管阶段（食团由食管下行至胃）。掌握“吞咽、呼吸及言语”知识点。